可致水生物体内污染物浓度呈几何级数增加的是
A. 生物蓄积作用
B. 生物浓缩作用
C. 生物放大作用
D. 水体污染
E. 水体自净作用

正确答案：C。生物放大作用

解析：本题考查生物放大作用。生物放大作用（C对ABDE错）是指在食物链中，污染物从低端生物体向高端生物体迁移过程中，出现高端生物体内污染物浓度以几何级数的倍数高于低端生物体的现象。